关于治疗药物监测的论述错误的是
A. 治疗药物监测的常用英文缩写是TDM
B. 是临床药学服务的重要内容之一
C. 治疗药物监测可以实现给药个体化
D. 所有的治疗药物都必须进行监测
E. 可以了解血药浓度

正确答案：D。所有的治疗药物都必须进行监测

解析：本题考查药物监测。并不是所有治疗药物都需要进行监测，药物监测只针对那些安全范围小的药物，如地高辛等（D错，为本题正确答案）。治疗药物监测（TDM）（A对）是药学服务的重要方式和途径（B对），根据检测结果，可以制定个体化用药方案（C对），通过监测，可及时了解患者的个体血浆药物水平（E对）。